急性龈乳头炎时，临床检查出现患牙有轻度叩痛提示
A. 龈乳头下方牙周膜有炎症和水肿
B. 根尖周有炎症
C. 有牙周脓肿
D. 有牙周创伤
E. 有急性牙髓炎

正确答案：A。龈乳头下方牙周膜有炎症和水肿

解析：本题考查急性龈乳头炎的临床表现。由于牙周膜中有可定位疼痛的神经，所以当牙周膜有炎症时叩诊会出现叩痛，急性龈乳头炎临床检查出现患牙有轻度叩痛，提示龈乳头炎症累及下方牙周膜，牙周膜有炎症和水肿（A对）。急性龈乳头炎累及的牙周膜面积小叩诊出现轻度叩痛，而根尖周有炎症（B错）时累及大面积的牙周膜出现重度叩痛。急性龈乳头炎病变属于牙龈病，病损局限于牙龈严重者累及牙周膜，不会引起牙周脓肿（C错）。有牙周创伤（D错）时叩痛明显，而急性龈乳头炎有轻度叩痛，叩痛的疼痛程度不同。有急性牙髓炎（E错）早期阶段患牙对叩痛无不适反应，而处于晚期炎症的患牙，因牙髓炎症的外围已波及根尖部的牙周膜，可出现垂直方向的轻度叩痛，急性龈乳头炎也会出现轻度叩痛，此时不易与急性龈乳头炎鉴别，可通过临床检查鉴别，检查可见龈乳头鲜红脓肿，探触痛明显，易出血可诊断为急性龈乳头炎。